有关栓剂的表述，不正确的是
A. 栓剂属于固体剂型
B. 栓剂的重量与基质的密度无关
C. 栓剂基质可分为油脂性和水溶性两大类
D. 肛门栓可通过直肠吸收药物，产生全身作用
E. 栓剂中的药物不受胃肠pH的破坏

正确答案：B。栓剂的重量与基质的密度无关